低效消毒剂是指能够杀灭的细菌是
A. 炭疽杆菌芽孢
B. 破伤风杆菌芽孢
C. 肉毒杆菌芽孢
D. 痢疾杆菌
E. 大多数病毒

正确答案：D。痢疾杆菌

解析：本题考查低效消毒剂能够杀灭的细菌。低效消毒剂是指只能杀灭除结核杆菌以外的抵抗力较弱的细菌，如链球菌、痢疾杆菌（D对ABCE错）、伤寒杆菌、葡萄球菌、绿脓杆菌等，以及抵抗力较弱的真菌（如念珠菌）和病毒（如流感病毒、脊髓灰质炎病毒、艾滋病病毒等）。